预防减压病的关键措施是
A. 减轻劳动强度
B. 保暖
C. 合理减压
D. 加强营养
E. 医疗保健

正确答案：C。合理减压